与胺碘酮延长心室肌APD作用机制有关的主要离子通道是
A. 钠通道
B. 钙通道
C. 镁通道
D. 氯通道
E. 钾通道

正确答案：E。钾通道